医院健康教育与健康促进的实施不包括
A. 建立医院健康促进组织网络
B. 创造有利于健康的医院环境
C. 加强医务人员的健康教育培训
D. 开展多种形式的健康教有活动
E. 移风易俗

正确答案：E。移风易俗